新生儿寒冷损伤综合征应首先辨别的是
A. 虚与实
B. 气与血
C. 表与里
D. 阴与阳
E. 寒与热

正确答案：A。虚与实

解析：新生儿寒冷损伤综合征首先辨别虚、实（A对）、寒、瘀。凡早产儿、体弱儿，喂养反应迟钝、哭声低微、气息微弱者，属于阳虚；体质尚可，皮肤硬肿、凉、暗、发紫，有冷冻史者属于寒实。